男，30岁，农民。神志不清，呼吸急促，肤色发绀，口角渗出大量血性泡沫状分泌物。查体：体温39.8℃，血压80/56mmHg，心率120次/min，皮肤黏膜多处可见瘀斑。右侧腹股沟淋巴结肿大并溃破，触之坚硬，与周围组织粘连。肺部闻及少量啰音。该患者最可能感染的细菌是
A. 炭疽芽孢杆菌
B. 鼠疫耶尔森菌
C. 肾综合征出血热病毒
D. 钩端螺旋体
E. 乙型溶血性链球菌

正确答案：B。鼠疫耶尔森菌